下列有关两步法取印模说法正确的是
A. 适用于单个牙位制取
B. 节约时间
C. 简便易行
D. 便于获得龈缘印模
E. 二次就位不易影响准确性

正确答案：D。便于获得龈缘印模

解析：该方法的优点是利于多个牙位修复体印模的制取，便于获得龈缘印模；缺点是取两次印模耗费时间，初印模二次就位时易影响准确性。掌握“暂时冠及印模与模型”知识点。